生后第一年身高增长约
A. 35cm
B. 32cm
C. 30cm
D. 27cm
E. 25cm

正确答案：E。25cm

解析：身高（长）指头部、脊柱与下肢长度总和。正常足月儿出生时身高平均为50cm，生后第1年身高增长最快，约为25cm（E对）。